七情致病，引起“气结”的情志是
A. 恐
B. 惊
C. 悲
D. 喜
E. 思

正确答案：E。思

解析：思虑过度，劳神伤脾，导致脾气郁结，运化失常，出现食欲不振等症状（E对）；恐则气下，过度恐惧可使肾气不固而陷下，出现二便失禁，遗精等症状（A错）；惊则气乱，大惊使心无所倚，神无所归，虑无所定，惊慌失措（B错）；悲则气消，过度悲优，可使肺气耗伤而出现胸闷，气短，乏力等症状（C错）；喜则气缓，暴喜过度可使心气涣散，神不守舍，甚则失神狂乱等症状（D错）。